利咽解毒颗粒的功能是
A. 清热润肺，止咳化痰
B. 疏风清热，消肿止痛
C. 养阴生津，清热消痰
D. 清肺利咽，解毒退热
E. 清热利咽，生津润燥

正确答案：D。清肺利咽，解毒退热

解析：本题考查的是利咽解毒颗粒的功能。利咽解毒颗粒的功能是清肺利咽，解毒退热（D对）。利咽解毒颗粒：【功能】清肺利咽，解毒退热。蜜炼川贝枇杷膏：【功能】清热润肺，化痰止咳（A错）。清音丸：【功能】清热利咽，生津润燥（E错）。功能为疏风清热，消肿止痛（B错）或养阴生津，清热消痰（C错）的中成药，2022年考试指南未明确说明。